男性，体重50Kg，躯干部、双臀及双大腿Ⅱ度烧伤，双小腿及双足Ⅲ度烧伤，第一个24小时应补充的胶体量约为
A. 1500ml
B. 1800ml
C. 2700ml
D. 3200ml
E. 3600ml

正确答案：C。2700ml

解析：根据中国新九分法，患者烧伤总面积=27%（躯干）+5%（双臀）+21%（双大腿）+13%（双小腿）+7%（双足）=73%。伤后第1个24小时，每1%Ⅱ度及Ⅲ度烧伤面积每公斤体重应补充胶体和电解质液共1.5ml。其中，胶体：电解质=0.5：1，广泛深度烧伤者比例可改为1：1。本例烧伤总面积高达73%，其中Ⅲ度烧伤面积20%（总面积50%以上或Ⅲ度20%以上为特重度烧伤），晶：胶比应取1：1。根据烧伤补液原则，该患者第一个24小时应补充的胶体量=烧伤面积×体重×1.5÷2=73×50×1.5÷2=2737.5，与选项中2700l接近（C对）。若算补液总量时需加2000ml基础水份，伤后前8小时内输入一半，后16小时输入另一半。